子宫内膜癌的治疗，错误的是
A. Ⅱ期应行改良广泛性子宫切除及双侧附件切除术，同时行盆腔淋巴结切除及腹主动脉旁淋巴结取样术
B. Ⅰ期患者腹水中有癌细胞的手术加放疗
C. Ⅰ期患者深肌层浸润的手术加放疗
D. Ⅰ期有浅肌层浸润者，术后常规应辅助放疗
E. 严重并发症不能耐受手术的放疗

正确答案：D。Ⅰ期有浅肌层浸润者，术后常规应辅助放疗

解析：子宫内膜癌Ⅰ期有浅肌层浸润者，无影响子宫内膜癌预后的高危因素（非子宫内膜样癌或低分化腺癌、深肌层浸润），不需术后常规应用辅助放疗（D错，为本题正确答案），而有深肌层浸润的Ⅰ期患者则需行手术加放疗（C对）。腹水中有癌细胞的Ⅰ期患者应重新确定分期为Ⅲ期，应行肿瘤细胞减灭术，以尽可能切除所有肉眼可见病灶为目的，术后联合放化疗可提高疗效（B对）。Ⅱ期应行广泛子宫切除术及双侧盆腔淋巴结及腹主动脉旁淋巴结清扫术（A对）。严重并发症不能耐受手术的患者应行放疗（E对）。